肝十二指肠韧带游离缘内主要结构的排列为
A. 右前方为门静脉，左前方为肝固有动脉，两者后方为胆总管
B. 右前方为胆总管，左前方为肝固有动脉，两者后方为门静脉
C. 右前方为胆总管，左前方为门静脉，两者后方为肝固有动脉
D. 右前方为肝固有动脉，左前方为门静脉，两者后方为胆总管
E. 右前方为门静脉，左前方为胆总管，两者后方为肝固有动脉

正确答案：B。右前方为胆总管，左前方为肝固有动脉，两者后方为门静脉

解析：胆总管位于肝固有动脉右侧，门静脉前方，故右前方为胆总管，左前方为肝固有动脉，后方为门静脉(B对)。